关于肾上腺素对血管收缩作用最强的是
A. 皮肤、黏膜血管
B. 肾血管
C. 肺血管
D. 脑血管
E. 小动脉及毛细血管

正确答案：A。皮肤、黏膜血管